眶下间隙感染向颅内扩散，并发海绵窦血栓性静脉炎，其扩散途径通常是
A. 面前静脉，颈内静脉
B. 颞浅静脉，内眦静脉
C. 面前静脉，颞浅静脉，颈内静脉
D. 面前静脉，内眦静脉，眼静脉
E. 眶内静脉，面前静脉

正确答案：D。面前静脉，内眦静脉，眼静脉

解析：本题考查眶下间隙感染向颅内扩散并发海绵窦血栓性静脉炎的扩散途径。眶下区肿胀范围常波及内眦、眼脸、颧部皮肤。因为眶下间隙中有丰富的血管网，如内眦动脉、面前静脉及其与眼静脉、眶下静脉、面深静脉的交通支，所以眶下间隙感染向上可向颅内直接扩散，形成眶内蜂窝织炎，也可沿面前静脉、内眦静脉、眼静脉（D对）向颅内扩散，并发海绵窦血栓性静脉炎。